烧伤面积的计算按中国九分法，双上肢面积占
A. 0.09
B. 0.18
C. 0.27
D. 0.36
E. 0.45

正确答案：B。0.18

解析：中国新九分法：按体表面积划分为11个9%的等份，另加1%，构成100%的体表面积，即头颈部：1×9%；躯干：3×9%；两上肢：2×9%；双下肢、臀部：5×9%+1%；共为11×9%+1%。双上肢为2×9%=18%（B对）。